影响四环素牙着色程度的主要因素是
A. 患者的发育情况
B. 患者的健康状况
C. 骨骼的矿化程度
D. 牙本质的矿化程度
E. 药物的种类、剂量、给药次数

正确答案：E。药物的种类、剂量、给药次数

解析：牙着色程度与四环素的种类、剂量和给药次数有关。一般认为，缩水四环素、去甲金霉素、盐酸四环素引起的着色比土霉素、金霉素明显；在恒牙，服用四环素的疗程数与着色程度呈正比关系，但是短期内的大剂量服用比长期给服相等的总剂量作用更大。掌握“四环素牙齿”知识点。